下列有关牙演化特点的描述中，不正确的一项是
A. 牙附着于颌骨的方式最后向槽生牙演化
B. 牙的分布由广泛至逐渐集中于上、下颌骨
C. 牙的替换次数由双牙列向多牙列演化
D. 牙形由单一同形牙向复杂异形牙演化
E. 牙数目由多变少

正确答案：C。牙的替换次数由双牙列向多牙列演化

解析：牙演化的特点：①牙形由单一同形牙向复杂异形牙演化；②牙数目由多变少；③牙的替换次数由多牙列向双牙列演化；④牙的分布由广泛至逐渐集中于上、下颌骨；⑤牙根从无到有，牙附着于颌骨的方式由端生牙至侧生牙，最后向槽生牙演化。掌握“牙的演化”知识点。